强心苷类化合物的性状多为
A. 无色
B. 晶体或无定形粉末
C. 中性物质
D. 有旋光性
E. 有挥发性

正确答案：A、B、D。无色；晶体或无定形粉末；有旋光性

解析：本题考查的是强心苷的性状。强心苷类化合物的性状多为无色（A对）、晶体或无定形粉末（B对）与有旋光性（D对）。强心苷的性状：强心苷多为无定形粉末或无色结晶，具有旋光性，C-17侧链为β构型者味苦，为α构型者味不苦。对黏膜具有刺激性。中性物质（C错）主要有甾体皂苷等。大多数甾体皂苷呈中性，少数三萜皂苷亦呈中性，如人参皂苷、柴胡皂苷等。挥发性（E错）为挥发油的理化性质。挥发油的挥发性：挥发油在常温下可自然挥发，如将挥发油涂在纸片上，较长时间放置后，挥发油因挥发而不留油迹，脂肪油则留下永久性油迹，据此可区别二者。挥发油可随水蒸气蒸熘。